男，65岁，初戴全口义齿时，发现补偿曲线曲度过小，该患者戴义齿后最容易出现的问题是
A. 义齿后缘压痛
B. 义齿后缘翘动
C. 前牙开（牙合）
D. 发音不清
E. 面容苍老

正确答案：B。义齿后缘翘动

解析：本题考查补偿曲线曲度过小易出现的问题。初戴全口义齿时，发现补偿曲线曲度过小，该患者戴义齿后最容易出现的问题是义齿后缘翘动（B对）。全口义齿修复中所指的补偿曲线多限于上颌尖牙至上颌第二磨牙颊尖顶相连，形成凸向下的曲线。全口义齿出现补偿曲线曲度过小时,会造成后牙过平,前牙覆（牙合）、覆盖深（C错）；导致前伸（牙合）时，后牙离开较晚，引起后缘的翘动。义齿后缘压痛（A错）是义齿基托缓冲不够造成的，发音不清（D错）是腭皱襞的形态和人工牙的排列位置不正确造成的，面容苍老（E错）是垂直距离恢复过低造成的，与补偿曲线曲度过小无关。